销售未经批准的药品构成
A. 虚假广告罪
B. 销售劣药罪
C. 销售假药罪
D. 生产假药罪
E. 非法经营罪

正确答案：C。销售假药罪

解析：本题考查假药的界定。销售未经批准的药品构成销售假药罪（C对）。有下列情形之一的药品，按假药论处：1.国务院药品监督管理部门规定禁止使用的；2.依照本法必须批准而未批准生产、进口或依照本法必须检验而未经检验即销售的；3.变质的；4.被污染的；5.使用依照本法必须取得批准文号而未取得批准文号的原料生产的；6.所标明的适应证或者功能主治超出规定范围的。